胰腺炎休克治疗错误的是
A. 利尿
B. 补充体液
C. 补充电解质
D. 去甲肾上腺素
E. 抗感染

正确答案：A。利尿

解析：重症胰腺炎患者早期易出现低血容量性休克，依据中心静脉压、血压、尿量、红细胞压积和电解质的监测，补充体液（B对）、补充电解质（C对）等物质，有效恢复循环血量和电解质平衡。上述情况改善后，排除心功能不全引起的低血压后，可以应用升压药物去甲肾上腺素（D对），此外还应给予广谱抗生素抗感染治疗（E对）。利尿剂会导致血容量降低，故一般不用于胰腺炎抗休克治疗（A错）。